属于特殊黏膜的是
A. 颊黏膜
B. 舌背
C. 硬腭
D. 舌腹
E. 唇红

正确答案：B。舌背

解析：本题考查口腔黏膜。属于特殊黏膜的是舌背（B对）。口腔黏膜根据所在的部位和功能可分为三类，即咀嚼黏膜、被覆黏膜和特殊黏膜。咀嚼黏膜包括牙龈和硬腭（C错）黏膜。被覆黏膜包括唇（E错）、颊黏膜（A错）、软腭黏膜、口底和舌腹（D错）黏膜。特殊黏膜即舌背黏膜。